患者于某因发热3日到县医院就诊，接诊医师林某检查后拟诊为流行性出血热。因县医院不具备隔离治疗条件，林某遂嘱患儿的家长带于某去市传染病医院就诊。按照传染病防治法的规定，林某应当
A. 请上级医师会诊，确诊后再转诊
B. 请上级医师会诊，确诊后隔离治疗
C. 向医院领导报告，确诊后对于某就地进行隔离
D. 向当地疾病控制机构报告，并复印病历资料转诊
E. 向当地疾病控制机构报告，由疾病控制机构转诊

正确答案：D。向当地疾病控制机构报告，并复印病历资料转诊